女，7岁，需拔除Ⅱ°松动的左下第一乳切牙，临床常用的麻醉方法是
A. 阻滞麻醉
B. 浸润麻醉
C. 表面麻醉
D. 冷冻麻醉
E. 针刺穴位麻醉

正确答案：C。表面麻醉

解析：本题考查局麻方法。题中Ⅱ°松动的左下第一乳切牙很容易拔除，仅需表面涂布麻醉剂（C对）即可，这样麻醉迅速，患儿容易配合。阻滞麻醉（A错）是将局麻药液注射到神经干或主要分支附近，以阻断神经末梢传入的刺激，产生麻醉效果，适用于浸润麻醉渗透作用差的部位。浸润麻醉（B错）一般多在上颌牙槽突或下颌前牙区的牙槽突应用，因这些部位牙槽骨质较薄，并且疏松多孔，局麻药易进入麻醉神经。冷冻麻醉（D错），常用氯乙烷，仅适用于黏膜下和皮下浅表脓肿的切开引流，以及松动乳牙的拔出，实际上属表面麻醉范畴，由于氯乙烷对黏膜刺激性大，临床已很少应用。针刺穴位麻醉（E错）是结合中医穴位疗法的一种麻醉方法，一般适用于对局麻药物过敏或者全身重大疾病不能接受麻醉药物的患者，尚存在镇痛不全、肌肉松弛不够等问题，目前临床上很少使用。